土鳖虫的性状鉴别特征有
A. 呈扁平卵形
B. 背部紫褐色，有光泽，无翅
C. 头部较大，有一对较长大的钳状脚须
D. 胸部有足3对，具细毛和刺
E. 后腹部末节有锐钩状毒刺

正确答案：A、B、D。呈扁平卵形；背部紫褐色，有光泽，无翅；胸部有足3对，具细毛和刺

解析：本题考查的是土鳖虫的鉴别特征。土鳖虫的性状鉴别特征有呈扁平卵形（A对）、背部紫褐色，有光泽，无翅（B对）与胸部有足3对，具细毛和刺（D对）。土鳖虫：【性状鉴别】药材地鳖呈扁平卵形。前端较窄，后端较宽，背部紫褐色，具光泽，无翅。前胸背板较发达，盖住头部；腹背板9节，呈覆瓦状排列。腹面红棕色，头部较小，有丝状触角1对，常脱落，胸部有足3对，具细毛和刺。腹部有横环节。质松脆，易碎。气腥臭，味微咸。头部较大，有一对较长大的钳状脚须（C错）与后腹部末节有锐钩状毒刺（E错）为全蝎的性状鉴别特点。全蝎：【性状鉴别】药材头胸部与前腹部呈扁平长椭圆形，后腹部呈尾状，皱缩弯曲。头胸部呈绿褐色，前面有1对短小的螯肢及1对较长大的钳状脚须，形似蟹螯，背面覆有梯形背甲，腹面有足4对；前腹部由7节组成。背面绿褐色，后腹部棕黄色，6节，节上均有纵沟，末节有锐钩状毒刺，毒刺下方无距。气微腥，味咸。